时间依赖型抗菌药物，药物浓度大于MIC的时间百分比（%T≥MIC）是预测临床疗效的常用PK/PD参数。头孢菌素类药物%T≥MIC的临床疗效靶值范围是
A. ≥50%～75%
B. ≥45%～100%
C. ≥80%
D. ≥40%～50%
E. ≥60%～70%

正确答案：B。≥45%～100%

解析：本题考查头孢菌素类药物的PK/PD参数。头孢菌素类药物%T≥MIC的临床疗效靶值范围是≥45%～100%（B对）。